能明目去翳，收湿生肌的药是
A. 炉甘石
B. 煅石膏
C. 决明子
D. 煅龙骨
E. 野菊花

正确答案：A。炉甘石

解析：本题考查的是炉甘石的功效。能明目去翳，收湿生肌的药是炉甘石（A对）。炉甘石：【功效】明目去翳，收湿生肌。石膏（B错）：【功效】生用：清热泻火，除烦止渴；煅用：收湿敛疮，生肌止血。决明子（C错）：【功效】清肝明目，润肠通便。龙骨（D错）：【功效】镇惊安神，平肝潜阳，收敛固涩，收湿敛疮。野菊花（E错）：【功效】清热解毒，疏风平肝。